使颌骨呈扇形骨质破坏
A. 舌癌
B. 骨肉瘤
C. 口腔癌
D. 牙龈癌
E. 原发性骨内鳞状细胞癌

正确答案：D。牙龈癌

解析：本题考查牙龈癌。使颌骨呈扇形骨质破坏的是牙龈癌（D对）。牙龈癌：为颌面部软组织恶性肿瘤，可侵犯颌骨。早期牙龈癌可侵犯颌骨的牙槽突，X线片上多显示为牙槽突破坏吸收。下颌牙龈癌继续发展，可使颌骨呈扇形骨质破坏，边缘可整齐也可凹凸不平；生长缓慢的病变，其破坏区边缘可有骨质增生表现。